氟化物防龋属于
A. 龋病一级预防
B. 龋病二级预防
C. 龋病三级预防
D. 以上都不是
E. 属于治疗，不是预防

正确答案：A。龋病一级预防

解析：龋病的一级预防：①进行口腔健康教育：普及口腔健康知识，了解龋病发生的知识，树立自我保健意识，养成良好口腔卫生习惯。②控制及消除危险因素：对口腔内存在的危险因素，应采取可行的防治措施。在口腔医师的指导下，合理使用各种氟化物的防龋方法，如：窝沟封闭、防龋涂料等。掌握“龋病三级预防”知识点。